湿物料中的水分不断气化并向热空气中移动的过程
A. 传热过程
B. 传质过程
C. 干燥过程
D. 辐射干燥
E. 介电加热于燥

正确答案：B。传质过程